根据抗菌药物的安全性、疗效、细菌耐药性、价格等因素，将抗菌药物分为3级
A. 一级、二级与三级
B. 使用级、限制使用级与特殊使用级
C. 使用级、备用使用级与限制使用级
D. 非限制使用级、备用使用级与限制使用级
E. 非限制使用级、限制使用级与特殊使用级

正确答案：E。非限制使用级、限制使用级与特殊使用级

解析：抗菌药物临床应用实行分级管理。根据安全性、疗效、细菌耐药性、价格等因素，将抗菌药物分为3级：非限制使用级、限制使用级与特殊使用级。掌握“抗菌药物临床应用概述及管理”知识点。